口腔的感染源有
A. 急性传染病患者
B. 潜伏期感染者
C. 病毒携带者
D. A+B+C
E. A+C

正确答案：D。A+B+C

解析：感染源及感染来源包括急性传染病患者、潜伏期感染者、病毒携带者。掌握“口腔医疗保健中的感染”知识点。